导致饮片变质的环境因素有
A. 空气
B. 日光
C. 湿度
D. 温度
E. 尘埃

正确答案：A、B、C、D。空气；日光；湿度；温度

解析：本题考查的是环境因素对中药质量变异的影响。导致饮片变质的环境因素有空气（A对）、日光（B对）、湿度（C对）与温度（D对）。药材、饮片、中成药在贮藏过程中，由于受到外界诸多因素的影响，其质量也会不断发生变化。这些外界因素包括：1.温度；2.湿度；3.日光；4.空气；5.霉菌；6.虫害；7.包装容器；8.贮存时间。